某地居民饮用受意外污染的井水后，相继出现大量出汗、头痛、烦躁不安，呼吸急促，吞咽困难，肝区疼痛，腹泻和黑尿等急性中毒症状，根据中毒症状最有可能是何种污染物引起
A. 氰化物
B. 金属镉
C. 酚类化合物
D. 砷化合物
E. 硝基苯类化合物

正确答案：C。酚类化合物

解析：本题考查酚类化合物的相关内容。某地居民饮用受意外污染的井水后，相继出现大量出汗、头痛、烦躁不安，呼吸急促，吞咽困难，肝区疼痛，腹泻和黑尿等急性中毒症状，根据中毒症状最有可能是酚类化合物（C对ABDE错）引起。